涌吐药的主治病证是
A. 癫痫发狂
B. 中风神昏
C. 燥咳痰黏
D. 虫积腹痛
E. 湿阻中焦

正确答案：A。癫痫发狂

解析：本题考查涌吐药的主治病证。涌吐药的主治病证是癫痫发狂（A对）。涌吐药：本类药适用于误食毒物，停留胃中，未被吸收；或宿食停滞不化，尚未入肠，脘部胀痛；或痰涎壅盛，阻碍呼吸，以及癫痫发狂等。开窍药：本类药主要适用于热陷心包或痰浊阻蔽所致的神昏谵语，以及惊痫、中风（B错）等病出现的突然昏厥之证。清化热痰药：主治热痰证，如咳嗽气喘，痰黄质稠者；若痰稠难咯，唇舌干燥之燥痰（C错）证，宜选质润之润燥化痰药；痰热癫痫、中风惊厥、瘿瘤、痰火瘰疬等，均可以清化热痰药治之。温里药：本类药主要适用于里寒证，包括中焦寒证、心肾阳衰之亡阳证、肾阳虚证、寒滞肝脉之疝痛、风寒湿痹、经寒痛经等，兼治寒饮咳喘、虫积腹痛（D错）等。消食药：本类药主要适用于食积不化所致的脘腹胀满、嗳腐吞酸、恶心呕吐、大便失常及脾胃虚弱、消化不良等证。临床应用时，食积每见气滞，故常配伍行气药；食积兼寒者，配温中散寒药；食积兼热者，配苦寒轻泻药；食积兼湿阻中焦（E错）者，配芳香化湿药；食积兼脾胃虚弱者，配补气健脾药。